中央性颌骨骨髓炎X线表现
A. 下颌骨体有大小不等的多房阴影
B. 下颌骨内有单房透明阴影，四周有白色骨质线
C. 颌骨内虫蚀状骨质破坏区，四周骨质可有破坏
D. 下颌角见骨质疏松脱钙，并有骨质增生
E. 下颌骨体有骨质破坏，并有死骨形成

正确答案：E。下颌骨体有骨质破坏，并有死骨形成

解析：本题考查中央性颌骨骨髓炎的X线表现。中央性颌骨骨髓炎X线显示骨破坏区有大块死骨形成（E对），与周围分界清楚，可伴有病理性骨折。下颌骨体有大小不等的多房阴影为多房型成釉细胞瘤的X线表现（A错）。下颌骨内有单房透明阴影，四周有白色骨质线为牙源性角化囊性瘤的X线表现（B错）。颌骨内虫蚀状骨质破坏区，四周骨质可有破坏为原发性骨肉瘤的X线表现（C错）。下颌角见骨质疏松脱钙，并有骨质增生为边缘性颌骨骨髓炎的X线表现（D错）。